自身输液的作用主要是指
A. 容量血管收缩，回心血量增加
B. 抗利尿激素增多，水重吸收增加
C. 醛固酮增多，钠水重吸收增加
D. 组织液回流多于生成
E. 动－静脉吻合支开放，回心血量增加

正确答案：D。组织液回流多于生成

解析：由于毛细血管前阻力血管比微静脉收缩强度更大，致使毛细血管中流体静压下降，组织液回流多于生成（D对），组织液进入血管。 这种代偿变化起到了自身输液的作用，是休克时增加回心血量的“第二道防线”。容量血管收缩，回心血量增加（A错）起到了自身输血的作用。抗利尿激素增多，水重吸收增加（B错）、醛固酮增多，钠水重吸收增加（C错）和动－静脉吻合支开放，回心血量增加（E错）具有一定代偿意，但不是自身输液的主要作用。